疝囊壁的一部分为腹内容物时称
A. 嵌顿性疝
B. Litter疝
C. Richter疝
D. 滑动性疝
E. 绞窄性疝

正确答案：D。滑动性疝

解析：疝囊壁的一部分为腹内容物（如阑尾、盲肠、乙状结肠、膀胱等）时称为滑动性疝（D对），属难复性疝。嵌顿性疝（P308）（A错）指腹内压突然升高时，疝内容物经扩张的疝囊颈进入疝囊，随后因囊颈的弹性收缩，将内容物卡住，使其不能回纳。Littre疝（B错）指疝内容物为小肠憩室（通常是Meckel憩室）的腹股沟疝；Richter疝（C错）又称肠管壁疝，指疝内容物为部分肠壁的疝，上述两种疝均属于嵌顿性疝。绞窄性疝（E错）指嵌顿疝合并疝内容物动脉性循环障碍，与嵌顿性疝实际上是一个病理过程的两个阶段。